下列药物类型中，那一类没有强心作用
A. 强心苷类
B. 拟交感胺类
C. β-受体阻滞剂
D. 磷酸二酯酶抑制剂
E. 钙敏化剂

正确答案：C。β-受体阻滞剂